某生理指标服从偏态分布，且过高属异常，为制定99%医学参考值范围，可计算
A. P50
B. P95
C. P99
D. P1
E. P5

正确答案：C。P99

解析：偏态分布的资料制定医学参考值范围常用百分位数法，且过高属异常说明采用单侧界值（上限），为制定99%医学参考值范围，可计算P99（C对）。制定医学参考值范围时若采用双侧界值，计算95%医学参考值范围可计算P2.5～P97.5，99%的医学参考值范围可计算P0.5～P99.5，制定医学参考值范围时若采用单侧界值，计算95%医学参考值上限范围可计算P95，下限可计算P5，99%的医学参考值范围上限可计算P99，下限可计算P1。